根据《关于禁止商业贿赂行为的暂行规定》，属于商业贿赂行为的有
A. 经营者在销售商品时以明示并如实入账的方式给予对方价格优惠
B. 经营者在购进商品时以明示方式给中间人佣金并如实入账
C. 经营者为推销某产品出资组织对方单位管理人员出国考察
D. 经营者为销售商品在账外暗中给对方单位回扣
E. 经营者在推销产品时，暗中给对方单位提供宣传费

正确答案：C、D、E。经营者为推销某产品出资组织对方单位管理人员出国考察；经营者为销售商品在账外暗中给对方单位回扣；经营者在推销产品时，暗中给对方单位提供宣传费

解析：本题考查商业贿赂行为的判定。根据《关于禁止商业贿赂行为的暂行规定》，经营者不得采用财物或者其他手段进行贿赂以销售或者购买商品（CE对）。在账外暗中给予对方单位或者个人回扣的（D对），以行贿论处；对方单位或者个人在账外暗中收受回扣的，以受贿论处。经营者销售或者购买商品，可以以明示方式给对方折扣，可以给中间人佣金。经营者给对方折扣、给中间人佣金的，必须如实入账。接受折扣、佣金的经营者必须如实入账。